男性，40岁，间歇性上腹痛3年，近日出现呕吐，吐后自觉舒适，吐物有酸臭味。诊断可能为
A. 消化性溃疡
B. 食管癌
C. 胃癌
D. 急性胃炎
E. 神经性呕吐

正确答案：A。消化性溃疡

解析：典型的消化性溃疡有如下临床特点：①慢性过程病史可达数年至数十年。②周期性发作与自发缓解相交替；发作常有季节性，多在秋冬或冬春之交发病，可因精神情绪不良或过劳而诱发。③发作时上腹痛呈节律性十二指肠溃疡表现为疼痛在两餐之间发生（饥饿痛），持续至下餐进食后缓解；胃溃疡表现为餐后约0.5～1小时发生，经1～2小时后逐渐缓解，至下餐进食后再重复上述节律。④体征溃疡活动时上腹部可有局限性压痛，缓解期无明显体征。掌握“消化性溃疡”知识点。